本条例不适用于下面哪个场所
A. 宾馆
B. 公园
C. 影剧院
D. 候诊室
E. 家庭客厅

正确答案：E。家庭客厅